关于医院污水处理，下列哪项论述是正确的
A. 仅需一级处理
B. 一级处理、二级处理可满足要求
C. 医院污水处理中污泥可作为肥料
D. 医院污水中放射性物质不需处理
E. 医院污水消毒后方可排放

正确答案：E。医院污水消毒后方可排放

解析：本题考查医疗机构污水的处理。医院污水的水质特点是含有大量的病原体─病菌、病毒和寄生虫卵；医院污水还含有消毒剂、药剂、试剂等多种化学物质；利用放射性同位素医疗手段的医院的污水还含有放射性物质。医院污水处理主要是消毒，即杀灭病原体，常用的方法是氯化消毒或用臭氧消毒。对医院污水和污泥采取严格的消毒处理措施后方可排放（E对ABCD错）。